女，38岁。粘液脓血便伴里急后重3年。近1周腹痛加重。体检：体温37.5℃，贫血貌，左下腹部轻压痛，抗生素治疗无效。为明确诊断，首选检查
A. 结肠镜
B. 腹部B超
C. 结肠X线气钡双重造影
D. 腹部CT
E. 腹部X线

正确答案：A。结肠镜

解析：中青年患者，粘液脓血便伴里急后重3年，近1周腹痛加重，查体：体温37.5℃（正常值为36℃～37℃，提示低热），贫血貌，左下腹部轻压痛，抗生素治疗无效，根据患者的病史，临床症状及体征，考虑最可能的诊断为溃疡性结肠炎，为明确诊断，首选检查为结肠镜，该检查是本病确诊的重要手段，结肠X线气钡双重造影（C错）不作为首选检查手段，可作为结肠镜检查有禁忌证或不能完成全结肠俭查时的补充。腹部B超（B错）、CT（D错）、X线（E错）可用于对该病并发症如中毒性巨结肠、肠穿孔等的诊断，但是并不多用于明确诊断。